对COX-2的抑制作用选择性较高的药物是
A. 阿司匹林
B. 布洛芬
C. 尼美舒利
D. 吡罗昔康
E. 保泰松

正确答案：C。尼美舒利

解析：本题考查选择性抑制COX-2的药物。尼美舒利（C对）可选择性抑制COX-2；阿司匹林（A错）、布洛芬（B错）均为非选择性的环氧酶抑制剂；吡罗昔康（D错）对COX-2抑制强于COX-1，但没有尼美舒利选择性强；保泰松（E错）抑制前列腺素的合成和释放，与环氧酶无关。